一男性，某省厅干部，平时不嗜烟酒，生活规律；但性情急躁，易激动，工作认真，争强好胜，雄心勃勃。1年前单位减员时调人某厂工作，常因小事上火，发脾气。3日前因心绞痛人院，诊断为冠心病。对于病人应采取哪种干预措施
A. 认知疗法
B. 药物疗法
C. 生物反馈疗法
D. 放松疗法
E. 以上都是

正确答案：E。以上都是